小儿生理性贫血发生的时期是在出生后
A. 4～5个月
B. 7～8个月
C. 1个月内
D. 6～7个月
E. 2～3个月

正确答案：E。2～3个月

解析：由于婴儿生长发育迅速，循环血量迅速增加等因素，红细胞数和血红蛋白量逐渐降低，至2～3个月（E对）时红细胞数降至3.0×10¹²/L左右，血红蛋白量降至100g/L左右，出现轻度贫血，称为“生理性贫血”。